一年季节中，“长夏”所属的是
A. 木
B. 火
C. 土
D. 金
E. 水

正确答案：C。土

解析：一年季节中，春属木（A错）。夏属火（B错）。长夏属土（C对）。秋属金（D错）。冬属水（E错）。